以下有关样本量的描述，叙述正确的是
A. 样本量宜大不宜小
B. 样本量越大资料越准确
C. 样本量足够就好
D. 样本量大小由调查可行性决定
E. 样本量估计不能采用经验法

正确答案：C。样本量足够就好

解析：本题考查样本量。在抽样调查中，样本容量的确定很重要。因为样本容量太大，会造成人力、物力和财力的很大浪费；样本容量太小，会使抽样误差太大，使调查结果与实际情况相差很大，影响调查的效果。因此，样本量足够即可（C对ABDE错）。